主受盛化物的脏腑是
A. 胃
B. 三焦
C. 脾
D. 大肠
E. 小肠

正确答案：E。小肠

解析：小肠主受盛化物，指小肠具有接受容纳胃腐熟之食糜，并作进一步消化的功能（E对）。胃的主要生理功能是主受纳和腐熟水谷（A错）。三焦的主要生理功能是运行津液和通行元气（B错）。人出生后，生命过程的维持及其所需精气血津液等营养物质的生成，均依赖于脾（胃）运化所化生的水谷精微，故称脾（胃）为“后天之本”“气血生化之源”（C错）。大肠的主要生理功能是主传导糟粕与主津（D错）。